根据《中华人民共和国执业医师法》的规定，全国医师资格考试办法的制定部门是
A. 国务院
B. 国务院劳动部门
C. 国务院人事部门
D. 国务院卫生行政部门
E. 国务院教育行政部门

正确答案：D。国务院卫生行政部门

解析：根据《中华人民共和国执业医师法》的规定，全国医师资格考试办法的制定部门是国务院卫生行政部门（D对）。